显微鉴别沉香的径向纵切面，可观察到
A. 射线的宽度，射线细胞呈径向延长的长方形
B. 射线的宽度和高度，射线细胞类圆形，纵向单列
C. 射线的高度，射线细胞类方形，排成横带状
D. 射线的高度，射线细胞长梭形，条状竖列
E. 射线的宽度，射线细胞长梭形，放射状排列

正确答案：C。射线的高度，射线细胞类方形，排成横带状